下列关于异烟肼的正确叙述有
A. 对结核分枝杆菌选择性高，作用强
B. 对繁殖期和静止期细菌均有杀灭作用
C. 对细胞内的结核杆菌无作用
D. 单用易产生耐药性
E. 抗菌作用的机制是抑制分枝杆菌酸的合成

正确答案：A、D、E。对结核分枝杆菌选择性高，作用强；单用易产生耐药性；抗菌作用的机制是抑制分枝杆菌酸的合成

解析：本题考查异烟肼。异烟肼对结核分枝杆菌具有高度抗菌作用（A对），对静止期结核杆菌有抑制作用，对繁殖期结核杆菌有杀灭作用（B错），且不受环境 pH 的影响，对细胞内外结核菌都能杀灭（C错）。异烟肼单用时易产生耐药性（D对）。异烟肼抗结核分枝杆菌的作用机制:异烟肼与菌体的β-酮脂酰载体蛋白合成酶形成复合体，抑制分枝杆菌细胞壁特有的重要成分分枝菌酸的合成（E对），损害了细胞壁的结构完整性和对菌体的屏障保护作用，引起结核分枝杆菌死亡。还可通过抑制结核分枝杆菌的DNA合成或抑制菌体的某些酶，引起菌体代谢紊乱而死亡。